银翘散中体现“去性取用”的是
A. 银花  连翘
B. 牛蒡子 薄荷
C. 荆芥穗  淡豆豉
D. 竹叶  芦根
E. 桔梗  甘草

正确答案：C。荆芥穗  淡豆豉

解析：银翘散中去性取用的配伍为荆芥穗、淡豆豉。两药为辛温之药，但辛而不烈，温而不燥，配入辛凉解表方中，增强辛散透表之力，是为“去性取用”之法（C对）。银花、连翘既能疏散风热，清热解毒，又可辟秽化浊（A错）。牛蒡子、薄荷疏散风热，清利头目，解毒利咽（B错）。芦根、竹叶清热生津（D错）。桔梗开宣肺气而止咳利咽，甘草调和药性、护胃安中（E错）。